双亲与兄弟、姐妹及子女的健康与疾病情况应记入
A. 现病史
B. 既往史
C. 个人史
D. 月经及婚育史
E. 家族史

正确答案：E。家族史

解析：本题考查口外病史记录。家族史（E对）：父母、兄弟、姐妹健康状况，有无与患者类似疾病，有无家族遗传倾向的疾病。